下列关于依那普利的说法正确的是
A. 依那普利是含有苯丙氨酸结构的药物
B. 依那普利分子中只含有1个手性中心
C. 依那普利口服吸收极差，只能静脉注射给药
D. 依那普利结构中含有碱性的赖氨酸基团是产生药效的关键药效团
E. 依那普利的代谢物为依那普利拉，具有抑制ACE的作用

正确答案：E。依那普利的代谢物为依那普利拉，具有抑制ACE的作用

解析：本题考查依那普利。依那普利体内代谢产物为依那普利拉，依那普利拉能够抑制血管紧张素转化酶（E对）；依那普利结构中不含苯丙氨酸（A错），含双羧基结构；依那普利分子中含有三个手性中心（B错）；依那普利拉在小肠内不易被吸收，因此口服利用度低，采用静脉注射给药（C错）；依那普利不含碱性的赖氨酸基团（D错）。